我国社会主义医学伦理学基本原则提出的时间是
A. 1949年
B. 1954年
C. 1965年
D. 1981年
E. 1996年

正确答案：D。1981年